夹闭一侧家兔颈总动脉引起全身动脉血压升高，其主要原因是
A. 血管容积减少，相对循环血量增多
B. 颈动脉窦受到牵拉刺激
C. 颈动脉体受到牵拉刺激
D. 颈动脉窦内压力降低
E. 颈动脉体内压力降低

正确答案：D。颈动脉窦内压力降低

解析：压力感受器为颈动脉窦和主动脉弓血管外膜下的感觉神经末梢，感受血管壁所受到的机械牵张刺激。夹闭家兔一侧颈总动脉时，颈动脉血流减少（A错），颈动脉窦压力降低（D对），血管所受到的牵拉刺激减少（B错），减弱了对压力感受器的刺激，反射性引起心率增快，心输出量增多，血管收缩，动脉血压增高。颈动脉体（CE错）是化学感受器，感受的是动脉血中O₂分压降低、CO₂分压升高和H⁺浓度升高等刺激。